放线菌引起的化脓性感染其脓液特征是
A. 黏稠，呈金黄色
B. 稀薄，呈血水样
C. 稀薄，呈蓝绿色
D. 稀薄，呈暗黑色
E. 可见到硫磺样颗粒

正确答案：E。可见到硫磺样颗粒

解析：放线菌感染表现为慢性脓肿及形成瘘管，向外排出的黄色黏稠的脓液中，肉眼可见的黄色米粒大小颗粒，称作硫黄样颗粒，为放线菌病的指征。掌握“放线菌属”知识点。